地黄主产地是
A. 浙江
B. 福建
C. 河南
D. 吉林
E. 江苏

正确答案：C。河南

解析：本题考查的是药材地黄的主产地。地黄主产地是河南（C对）。地黄：【产地】主产于河南省武陟、温县、博爱等县。主产地为浙江（A错）的是浙药。浙药：主产地浙江。如传统的“浙八味”——浙贝母、白术、延胡索、温郁金、玄参、杭白芍、杭菊花、杭麦冬；以及山茱萸、莪术、杭白芷、栀子、乌梅、乌梢蛇等。主产地为福建（B错）的药材有泽泻、桑寄生、薏苡仁、青黛等。主产地为吉林（D错）的药材有人参、五味子、鹿茸等。主产地为江苏（E错）的药材有虎杖、太子参、威灵仙、木通、侧柏叶、紫苏叶、洋金花、地肤子、菟丝子等。